阿托品治疗有机磷中毒的主要作用是
A. 解除毒蕈碱样症状和促使胆碱酯酶复活
B. 解除烟碱样症状
C. 解除中枢神经系统症状和毒蕈碱样症状
D. 促使胆碱酯酶活性恢复
E. 解除烟碱样症状和毒蕈碱样症状

正确答案：C。解除中枢神经系统症状和毒蕈碱样症状